有关精索的描述，哪个说法错误
A. 是一对柔软圆索状结构
B. 是输精管的精索部
C. 由腹股沟管腹环延至睾丸上端
D. 主要成分为输精管、睾丸动脉、蔓状静脉丛等
E. 表面包有三层被膜，由外向内为精索外筋膜、提睾肌、精索内筋膜

正确答案：B。是输精管的精索部

解析：由腹股沟管腹环延至睾丸上端（C对）的一对柔软圆索状结构（A对）为精索。精索内主要有输精管和睾丸动脉、蔓状静脉丛等（D对）。精索表面包有三层被膜，从内向外依次为精索内筋膜、提睾肌和精索外筋膜（E对）。输精管的精索部（B错，为本题正确答案）是精索组成成分的一部分，精索内还包括睾丸动脉、蔓状静脉丛、输精管血管、神经、淋巴管和腹膜鞘突的残余（鞘韧带）等。